当水体pH值降低时，最有可能的污染是
A. 汞
B. 有机物
C. 碳酸钙
D. 碳酸镁
E. 铁

正确答案：B。有机物

解析：本题考查造成水体pH值降低的污染。水体pH值的变化会影响水体中的物质的溶解度，从而影响水体的污染程度。当水体pH值降低时，有机物（B对ACDE错）的溶解度会增加，从而使水体污染程度增加。